取得印鉴卡的医疗机构违反规定，未依照规定购买、储存麻醉药品和第一类精神药品的，可处以
A. 警告、暂停执业活动
B. 吊销印鉴卡
C. 吊销执业证书
D. 处1万元以上罚款
E. 降级，撤职，开除

正确答案：B。吊销印鉴卡

解析：取得印鉴卡的医疗机构未依照规定购买、储存麻醉药品和第一类精神药品的，由设区的市级人民政府卫生主管部门责令限期改正，给予警告；逾期不改正的，处5千元以上1万元以下的罚款；情节严重的，吊销其印鉴卡。掌握“麻醉、精神药品的使用及法律责任”知识点。